男，43岁。进行性活动后心悸、气短5年。1周前受凉后咳嗽、咳黄痰，喘憋加重，夜间不能平卧。否认慢性咳嗽史。查体：BP100/60mmHg，双肺可闻及细湿啰音。心界向左扩大，心率115次/分，律齐，P₂亢进。该患者喘憋的最可能原因是
A. 心力衰竭
B. 急性心肌炎
C. 慢性支气管炎急性发作
D. 肺栓塞
E. 支气管哮喘

正确答案：A。心力衰竭

解析：患者中年男性，活动后心悸、气短，1周前受凉（心力衰竭的常见诱因）后咳嗽、咳黄痰，喘憋加重，夜间不能平卧，双肺可闻及细湿啰音，心界向左扩大（心力衰竭的常见表现），应考虑诊断为心力衰竭（A对）。急性心肌炎（P270）（B错）患者发病前1～3周有病毒感染前驱症状，如发热、全身倦怠感和肌肉酸痛等，且常有心律失常，以房性与室性期前收缩及房室传导阻滞最常见。慢性支气管炎急性发作（P20）（C错）有慢性咳嗽史。肺栓塞（P100）（D错）主要表现为突然发生的呼吸困难、剧烈胸痛、发热、咯血等。支气管哮喘（P29）（E错）常见于年轻患者，且发病前多有过敏原接触史，典型症状为发作性伴有哮鸣音的呼气性呼吸困难，典型的体征为双肺可闻及广泛的哮鸣音，呼气音延长。